下牙槽神经口内法阻滞麻醉时，为使针尖避开下颌小舌的阻挡，触及骨面时针尖应在
A. 下颌神经沟
B. 下颌小舌平面以上
C. 下颌小舌平面
D. 下颌孔
E. 以上都不是

正确答案：B。下颌小舌平面以上

解析：本题考查下牙槽神经口内注射法。下牙槽神经口内法阻滞麻醉时，为使针尖避开下颌小舌的阻挡，触及骨面时针尖应在下颌小舌上方（B对）1.0cm处。下颌孔位于下颌支内面中心的后上方，孔呈漏斗状，为下牙槽神经血管进入下颌管的入口；孔前内侧有一细小的尖形骨突，称下颌小舌，有蝶下颌韧带附着。